男，75岁，因左上臂丛损伤频发左上臂疼痛，该疼痛属于
A. 病边侵犯
B. 痛觉过敏
C. 放射性痛
D. 扩散性痛
E. 牵涉痛

正确答案：C。放射性痛

解析：患者左上臂丛损伤（提示为神经根损伤）后，出现频发左上臂疼痛（上臂丛支配区），故该频发痛属于放射性痛（C对）。放射性痛是由于神经干、神经根或中枢神经系统内的感觉传导受到刺激或压迫使得疼痛沿着神经向末梢方向传导，以致在远离病变的受累神经分布区内出现疼痛，患者左上臂的频发疼痛为典型的上臂丛损伤所致的放射痛。周围病变侵犯（A错）尚缺乏相关病史及影像学表现支持。痛觉过敏（B错）表现为轻微的触摸皮肤即感到疼痛难忍等，多见于丘脑或周围神经病变。扩散性痛（D错）为一个神经分支的疼痛扩散到另一神经的分支区。牵涉痛（P708）（E错），亦称感应痛或反射痛，多指某些内脏器官病变时，刺激经脊神经后根或脊髓丘脑束及相应的一二级神经元，使同一节段的神经元兴奋，在相应的皮肤支配区出现感觉异常。